评价挥发油质量的物理常数有
A. 比旋度
B. 折光率
C. 相对密度
D. 熔点
E. 闪点

正确答案：A、B、C。比旋度；折光率；相对密度

解析：本题考查的是本题考查挥发油的特性。评价挥发油质量的物理常数有比旋度（A对）、折光率（B对）与相对密度（C对）。挥发油的物理常数：挥发油多数比水轻，也有的比水重（如丁香油、桂皮油），相对密度一般在0.85～1.065之间。挥发油几乎均有光学活性，比旋度在+97°～+117°范围内。多具有强的折光性，折光率在1.43～1.61之间。挥发油的沸点一般在70℃～300℃之间。熔点（D错）与闪点（E错），并非评价挥发油质量的物理常数。